下颌在保持一侧上、下颌牙接触的同时向该侧移动，运动过程中所有下颌的位置都称为
A. 最大侧向颌位
B. 侧（牙合）颌位
C. 非工作侧（牙合）干扰
D. 侧向平衡（牙合）
E. 最大前伸颌位

正确答案：B。侧（牙合）颌位

解析：下颌在保持一侧上、下颌牙接触的同时向该侧移动，运动过程中所有下颌的位置都称为侧（牙合）颌位。掌握“下颌姿势位、三类颌位与前伸、侧方（牙合）颌位”知识点。